藤黄常采用的炮制方法是
A. 甘草水煮
B. 水煮
C. 酒蒸
D. 豆腐煮
E. 姜汤煮

正确答案：D。豆腐煮

解析：本题考查煮法。藤黄常采用的炮制方法是豆腐煮（D对）。煮：将净选过的药物加辅料或不加辅料放人锅内（固体辅料需先捣碎或切制），加适量清水同煮的方法称为煮法。煮制是利用水、辅料或药汁的温度加热药物，无论是清水煮（如川乌、草乌）、加液体辅料或药汁煮（如附子、吴茱萸、远志），还是用固体辅料豆腐煮（如藤黄、硫黄），其主要目的都是为了降低毒性或消除副作用。煮制的操作方法：煮制的操作方法因各药物的性质、辅料来源及炮制要求不同而异，分为以下3种方法。①清水煮（B错）：如黄芩。②药汁煮或醋煮：如醋莪术，甘草水煮（A错）远志。③豆腐煮，将药物置豆腐中，放置于适宜容器，加水没过豆腐，煮至规定程度，取出放凉，除去豆腐。适量加水，中途需加水时，应加沸开水。蒸制：是利用水蒸气加热药物（或药物与辅料）的方法。不加辅料蒸制的时间较短，其目的是软化药材，便于切制或使药物便于保存，如清蒸木瓜、天麻、桑螵蛸、黄芩、人参等。加辅料蒸制的时间相对较长，主要目的在于改变药物性味，产生新的功能，扩大临床适用范围，如酒蒸（C错）地黄、大黄，黑豆汁蒸何首乌；亦可增强疗效，如酒蒸肉苁蓉、黄精、山茱萸、女贞子、五味子等。姜炙的操作方法：将药物与定量的姜汁拌匀，放置闷润，使姜汁逐渐渗入药物内部。然后置炒制容器内，用文火炒至规定程度，取出晾凉。或者将药物与姜汁拌匀，待姜汁被吸尽后，进行干燥。姜汤煮（E错）：将鲜姜切片煎汤，加入药物煮2小时，待姜汁基本被吸尽，取出，切片，干燥。